在诊疗同意制度中，如果病人方面的意见不统一，医师应当以谁的意见为准
A. 病人家属或者关系人
B. 病人本人
C. 应当等病人和家属或者关系人意见统一后才能决定诊疗方案
D. 对病人诊疗有利者
E. 医师独立作出决定

正确答案：B。病人本人

解析：施行手术、特殊检查或者特殊治疗时，必须征得患者同意，并应当取得其家属或者关系人同意并签字。掌握“医疗机构概述及机构执业”知识点。